喹诺酮类药物的抗菌机制是
A. 抑制细胞壁合成
B. 抑制细菌蛋白质合成起始阶段
C. 改变细菌胞浆膜的通透性
D. 抑制细菌mRNA的合成
E. 抑制细菌DNA回旋酶和拓扑异构酶Ⅳ

正确答案：E。抑制细菌DNA回旋酶和拓扑异构酶Ⅳ

解析：本题考查喹诺酮类药物的作用机制。喹诺酮类药的作用靶位在细菌的DNA旋转酶，通过抑制细菌DNA回旋酶和拓扑异构酶Ⅳ（E对）发挥抗菌作用。